女，60岁，绝经7年、阴道淋漓流血19天，高血压史5年，糖尿病病史8年，G1P0，妇科检查：外阴阴道无异常，宫颈光滑，子宫正常大小，双侧附件区无异常，超声示子宫内膜0.8cm，回声不均匀，内膜血流较丰富。为明确诊断，应进行的检查是
A. 阴道镜活检
B. 腹腔镜探查
C. 盆腔MRI检查
D. 宫颈细胞学检查
E. 诊断性刮宫

正确答案：E。诊断性刮宫

解析：患者绝经后妇女，阴道流血，超声检查子宫内膜回声不均匀，血流较丰富。结合患者年龄、临床表现及影像学检查，最可能的诊断是子宫内膜癌。诊断性刮宫（E对） 是常用而有价值的诊断方法。常行分段诊刮，以同时了解宫腔和宫颈的情况 。诊刮后进行组织学检查以确诊子宫内膜癌。宫颈细胞学检查（E错）常用于子宫颈癌的筛查及初步诊断。